生后48小时内无胎便或少量胎便，以后即有顽固性便秘和腹胀，最常见于
A. 继发性巨结肠
B. 特发性巨结肠
C. 功能性便秘
D. 先天性肠闭锁
E. 先天性巨结肠

正确答案：E。先天性巨结肠

解析：患儿生后48小时内即无排便且合并腹胀，为典型的先天性巨结肠临床表现（E对）。继发性巨结肠（A错）肛门、直肠末端有器质性病变。特发性巨结肠（B错）无新生儿便秘史，2~3岁出现症状。功能性便秘（C错）排便次数减少、排便费力、粪质较硬或呈球状、排便不尽感。先天性肠闭锁（D错）常出现呕吐。